过敏性休克治疗药物是
A. 缩血管药
B. 扩血管药
C. 补充血容量
D. 盐皮质激素
E. 心得安

正确答案：A。缩血管药

解析：对过敏性休克应使用缩血管药物（A对B错）以升高血压，保证心脑重要器官的血液灌流。过敏性休克时，虽然无明显的失液，但由于血管床容量增加，有效循环血量明显减少，也应根据实际需要来补充血容量（C错）。盐皮质激素（D错）的主要生理作用是促进肾小管重吸收钠而保留水，并排泄钾。心得安（普萘洛尔）（E错）用于治疗多种原因所致的心律失常，也可用于心绞痛、高血压、嗜铬细胞瘤（手术前准备）等。